心室收缩时颈静脉有搏动，可见于
A. 高血压病
B. 严重贫血
C. 三尖瓣关闭不全
D. 主动脉瓣关闭不全
E. 甲状腺功能亢进症.

正确答案：C。三尖瓣关闭不全

解析：心室收缩时颈静脉有搏动，可见于三尖瓣关闭不全（C对），三尖瓣关闭不全的患者在心室收缩时血液自右心室逆流入右心房，引起颈静脉收缩期搏动充盈，颈部可以观察到搏动。高血压病（A错）、严重贫血（B错）、主动脉瓣关闭不全（D错）、甲状腺功能亢进症（E错）在安静状态下表现为明显的颈动脉搏动，提示心排血量增加或脉压增加。